流行性乙型脑炎的病变性质为
A. 变质性炎
B. 浆液性炎
C. 纤维素性炎
D. 化脓性炎
E. 增生性炎

正确答案：A。变质性炎

解析：流行性乙型脑炎是由乙型脑炎病毒感染引起的变质性炎（A对）。流行性脑脊髓膜炎（P332）是由脑膜炎双球菌感染引起的急性化脓性炎（D错）。浆液性炎（P75）（B错）和纤维素性炎（P75）（C错）均属于急性渗出性炎，前者以浆液渗出为特征，后者以纤维蛋白原渗出为特征。增生性炎（E错）以实质和间质细胞增生为特征，如伤寒（P358）。